下列各项，属心生理功能的是
A. 主藏气
B. 主藏神
C. 主藏血
D. 主藏精
E. 主藏津

正确答案：B。主藏神

解析：心者，君主之官，神明出焉，为五脏六腑之大主，具有统帅人体生命活动和主宰意识、思维等精神活动的机能（心主藏神）（B对）；主藏气是肺的生理功能（A错）；主藏血是肝的生理功能（C错）；主藏精是肾的生理功能（D错）。